细胞坏死的主要形态学特征是
A. 核分裂
B. 细胞核异型
C. 线粒体肿胀
D. 细胞核碎裂
E. 细胞质脂质增多

正确答案：D。细胞核碎裂

解析：细胞坏死的的主要形态学特征是细胞核的变化，包括细胞核固缩、细胞核碎裂（D对）和细胞核溶解。核分裂（A错）和细胞核异型（B错）均为恶性肿瘤的主要形态学特征。线粒体肿胀（C错）是细胞水肿（P15）的主要形态学特征。细胞质脂质增多（E错）是细胞脂肪变性（P15）的主要形态学特征。